教学用房的外墙与城市主要干道同侧路边距离不应小于
A. 50m
B. 80m
C. 100m
D. 200m
E. 300m

正确答案：B。80m